疾病监测的目的是
A. 预防和控制疾病
B. 收集和分析健康资料
C. 确定致病因素
D. 向卫生官员报告某人群某疾病的流行状况
E. 以上均是

正确答案：E。以上均是